以下哪项为以前所述的组织细胞增生症
A. McCune-Albright综合征
B. 纤维结构不良
C. 巨细胞肉芽肿
D. 慢性唾液腺炎
E. 朗格汉斯细胞组织细胞增生症

正确答案：E。朗格汉斯细胞组织细胞增生症

解析：本题考查颌骨疾病。朗格汉斯细胞组织细胞增生症（E对）为朗格汉斯细胞的肿瘤性增生，又称为组织细胞增生症。通常根据疾病的严重程度，朗格汉斯细胞组织细胞增生症可分为以下三种类型：嗜酸性肉芽肿、汉-许-克病及勒-雪病，这些病损由于发病年龄、病变部位和朗格汉斯细胞增生的程度不同，而出现不同的症状、病程及预后。纤维结构不良（B错）又称为纤维异常增殖症，可累及单骨或多骨。McCune-Albright综合征（A错）为多骨性损害同时伴有皮肤色素沉着和女性性早熟等内分泌异常。巨细胞肉芽肿（C错）为多核巨细胞的颌骨病变。慢性唾液腺炎（D错）为唾液腺疾病，发生于下颌下腺及腮腺。